早期流产应与以下哪种疾病鉴别
A. 异位妊娠
B. 葡萄胎
C. 功能失调性子宫出血
D. 子宫肌瘤
E. 以上都需要鉴别

正确答案：E。以上都需要鉴别

解析：异位妊娠，葡萄胎，功能失调性子宫出血及子宫肌瘤都应以早期流产鉴别，症状较相似。掌握“自然流产”知识点。